在人类唾液中与龋病发病关系最密切的抗体
A. IgA
B. S-IgA
C. IgM
D. IgM和IgA

正确答案：B。S-IgA

解析：本题考查人体抗龋免疫反应。唾液中特异性S-IgA抗体水平升高，并能明显达到预防龋病的效果，故在人类唾液中与龋病发病关系最密切的抗体是S-IgA（B对）。与变异链球菌细胞、细胞壁、抗原Ⅰ/Ⅱ和GTF相关的血清抗体为IgG、IgM和IgA。血清抗体的免疫学研究结果不一，但已有一些证据表明无龋成人或经过治疗的龋患者，其血清抗体水平与龋病指数呈负相关，而患龋者呈正相关。龋病发生时，血清IgG和IgM有轻度但显著性增加。